流行性脑脊髓膜炎血象改变是
A. 白细胞总数下降，血小板增加
B. 白细胞总数升高，分类淋巴细胞为主
C. 白细胞总数升高，分类中性粒细胞为主
D. 白细胞总数下降，分类以淋巴细胞为主
E. 白细胞总数正常，分类中性粒细胞减少

正确答案：C。白细胞总数升高，分类中性粒细胞为主

解析：流行性脑脊髓膜炎血常规检查：白细胞总数明显增加，一般在（10～20）×10⁹/L 以上，高者可达40×10⁹/L或以上，中性粒细胞升高在 80%～90%以上。并发DIC者血小板减少（C对）。